风湿性心肌炎的临床表现下列哪项是错误的
A. 出现早搏和心动过速
B. 心率增快
C. 心前区第一心音减弱
D. 严重时可出现奔马律
E. 心尖区可听到隆隆样收缩期杂音

正确答案：E。心尖区可听到隆隆样收缩期杂音

解析：心肌炎常为全身性疾病的一部分，风湿性心肌炎见于风湿热的病程中，其临床表现为：①心率加快（B对），与体温升高不成比例；②心尖部第一心音低钝（C对），有时可闻及奔马律（D对），心尖部可听到轻度收缩期杂音；③心律失常，可出现不同程度的房室传导阻滞、期前收缩等，ECG可显示P-R间期延长及T波低平和ST段异常，此外加速性结性心动过速、短阵性房性心动过速亦可出现（A对）；④心脏轻度或明显扩大。心尖区可听到收缩期杂音多见于心内膜炎，累积二尖瓣时，杂音表现为吹风样，故心尖区可听到隆隆样收缩期杂音不是风湿性心肌炎的临床表现（E错，为本题正确答案）。